可用于治疗口腔溃疡，大剂量服用后，尿液可能呈黄色的药物是
A. 维生素A
B. 维生素B
C. 维生素C
D. 维生素E
E. 维生素K₁

正确答案：B。维生素B

解析：本题考查各种维生素的作用。可用于治疗口腔溃疡，大剂量服用后，尿液可能呈黄色的药物是维生素B（B对）。维生素B用于预防和治疗维生素B族缺乏所致的营养不良、厌食、脚气并糙皮病等，大剂量服用后，尿液可能呈黄色。维生素A（A错）用于治疗维生素A缺乏症，如夜盲症、干眼病、角膜软化症和皮肤粗糙等。维生素C（C错）用于预防坏血病，也可用于各种急慢性传染疾病及紫癜等的辅助治疗。维生素E（D错）用于进行性肌营养不良、习惯性流产及不孕症的辅助治疗。维生素K₁（E错）用于维生素K₁缺乏引起的出血，如梗阻性黄疸、胆瘘、慢性腹泻等所致出血。